脑膜中动脉穿经颅底的
A. 圆孔
B. 卵圆孔
C. 棘孔
D. 内耳门
E. 破裂孔

正确答案：C。棘孔

解析：下颌神经穿卵圆孔，上颌神经穿圆孔（AB错）。破裂孔续于颈动脉管内口（E错）。面神经穿内耳门（D错）。脑膜中动脉沟自棘孔向外上方走行（C对）。